某自来水厂工人，工作中不慎吸人氯气。出现咳嗽和流泪等症，休息后稍缓解。下班后，自觉胸闷加重，送医院就诊。查体：口唇轻度发绀，咽部充血，双肺呼吸音减低。可闻及散在干性罗音，未闻及湿罗音。X线胸片示：肺纹理增多、增粗。应诊断为氯气中毒的
A. 刺激反应
B. 轻度中毒
C. 中度中毒
D. 迟发性中毒
E. 重度中毒

正确答案：B。轻度中毒

解析：本题考查氯气轻度中毒症状。当发生氯气的轻度中毒（B对ACDE错）时，表现为急性气管-支气管炎或支气管周围炎。此时呛咳加重、出现呛咳、可有少量痰、胸闷，两肺有散在性干、湿啰音或哮鸣音，胸部X线表现可无异常或可见下肺野有肺纹理增多、增粗、延伸、边缘模糊。